牙隐裂可用的检查方法有
A. 咬诊
B. 探诊
C. 染色法
D. A和C
E. A、B、C三项

正确答案：E。A、B、C三项

解析：本题考查牙隐裂的检查方法。隐裂很难用肉眼发现。检查隐裂的方法有：利用灯光和口镜多角度照射、棉卷咬诊（A对）、探针加力探诊（B对）、深色液体的浸染（C对）等。（ABC均对，故E为本题的正确答案）。